关于牙钳使用，下列正确的是
A. 钳喙应尽量向根方夹持
B. 夹持不可太紧，否则易断根
C. 多个牙拔除时尽量选用万能牙钳
D. 手掌握持时应尽量靠近牙钳关节
E. 使用牙钳只能唇（颊）舌（腭）向摇动，否则易断根

正确答案：A。钳喙应尽量向根方夹持

解析：本题考查牙钳的使用。关于牙钳使用正确的是钳喙应尽量向根方夹持（A对）。使用牙钳时，钳喙应尽量向根方夹持，这样能更多的夹住牙齿，夹持更稳，便于施力。夹持不紧（B错）会使牙钳松动甚至损伤邻牙、对牙合牙，所以拔牙过程中一定要夹紧患牙；断根是由于牙钳选择不当、牙钳安放不对、牙体有缺损、老年人牙齿脆性增加、牙根形态异常、牙齿固连等因素造成的，与夹持太紧并无关系。牙拔除应根据术者习惯和各牙的情况选择各自合适的牙钳，不能因为一次拔除多个牙为了省事而选用万能牙钳（C错）。牙钳握持时握持区应尽量靠钳柄末端区，以增大牙钳的杠杆机械效率；若靠近牙钳关节（D错），力矩较短，拔牙时会很费力，效率不高甚至断根。拔牙主要有三种力：摇动、扭转、牵引，上颌中切牙和尖牙是圆锥形单根牙，可用扭转力而不会断根；多根牙、扁根牙、弯根牙不能进行扭转，否则会出现断根。因此使用牙钳只能唇（颊）舌（腭）向摇动，否则易断根（E错）的说法是不全面的。